患者，男，66岁。体检时发现血糖高前来就诊，有磺胺药过敏史，体型肥胖。医师处方二甲双胍片（0.5g，tid）控制血糖。联合用药应注意监测的主要不良反应是
A. 光敏反应
B. 低血糖反应
C. 糖尿病酮症酸中毒
D. 急性胰腺炎
E. 尿路感染

正确答案：B。低血糖反应

解析：本题考查二甲双胍的不良反应。二甲双胍会降低血糖，与其它降糖药物联合使用，会使血糖进一步降低，导致低血糖反应（B对）。光敏反应（A错）可能为灰黄霉素抗生素及氟喹诺酮类药物导致。糖尿病酮症酸中毒（C错）是大部分降糖药均会有的不良反应，不是联合用药导致。急性胰腺炎（D错）可能为胰高糖素样多肽-1受体激动剂导致。口服降糖药合用不会引起尿路感染（E错）。